治疗痰壅气逆，咳喘痰多，胸闷食少，甚则不能平卧，宜选用的药物是
A. 紫苏子、白芥子、莱菔子
B. 紫菀、款冬花、川贝母
C. 桑叶、贝母、北沙参
D. 杏仁、麻黄、甘草
E. 麻黄、石膏、杏仁

正确答案：A。紫苏子、白芥子、莱菔子

解析：该题考查化痰止咳平喘药物的配伍。紫苏子、白芥子、莱菔子用于治痰壅气逆，咳喘痰多，胸闷食少，甚则不能平卧（A对）。紫菀、款冬花、川贝母用于肺热咳喘（B错）。桑叶、贝母、北沙参用于肺热或燥热伤肺，咳嗽痰少，色黄而黏稠，或干咳少痰、咽痒（C错）。杏仁、麻黄、甘草用于风寒咳喘（D错）。麻黄、石膏、杏仁用于治疗肺热壅盛、高热喘急（E错）。